三级文献的评价标准包括
A. 作者的经验和水平
B. 编书的目的和用途
C. 引用参考文献的质量
D. 出版发行的年代
E. 出版发行的版次

正确答案：A、B、C、D、E。作者的经验和水平；编书的目的和用途；引用参考文献的质量；出版发行的年代；出版发行的版次